动眼神经的副交感纤维来自
A. 上涎核
B. 下涎核
C. 孤束核
D. 动眼神经副核
E. 动眼神经核

正确答案：D。动眼神经副核

解析：动眼神经含一般躯体运动纤维及副交感纤维。一般躯体运动纤维来自动眼神经核（E错），而副交感纤维来自动眼神经副核（D对），支配瞳孔括约肌及睫状肌。